白色血栓形成的主要成分是
A. 纤维素
B. 中性粒细胞
C. 血小板
D. 单核细胞
E. 红细胞

正确答案：C。血小板

解析：白色血栓形成的主要成分是血小板（C对）及少量纤维蛋白。纤维素（A错）是透明血栓（纤维素性血栓）（P53）的主要成分。红细胞（E错）是混合血栓和红色血栓的主要成分。